复元活血汤的功用为
A. 活血行气，祛瘀养血
B. 活血祛瘀，行气止痛
C. 活血行气，祛瘀通络
D. 活血祛瘀，疏肝通络
E. 活血行气，疏肝通络

正确答案：D。活血祛瘀，疏肝通络

解析：复元活血汤方含桃仁、红花、当归、大黄、瓜蒌根、炮穿山甲、柴胡，以活血祛瘀，疏肝通络。（D对）。